银翘散和桑菊饮的组成中均含有的药物有
A. 连翘、薄荷、杏仁、芦根
B. 连翘、薄荷、桔梗、杏仁
C. 银花、薄荷、桔梗、芦根
D. 银花、薄荷、桔梗、生甘草
E. 连翘、薄荷、桔梗、生甘草

正确答案：E。连翘、薄荷、桔梗、生甘草

解析：银翘散与桑菊饮都是治疗温病初起的辛凉解表方剂，组成中都有连翘、桔梗、薄荷、甘草（E对）、芦根五药,以辛凉解表。银翘散方歌—银翘散主上焦疴，竹叶荆蒡豉薄荷，甘桔芦根凉解法，风温初感次方宜。桑菊饮方歌—桑菊饮中桔梗翘，杏仁甘草薄荷饶，芦根为引轻清剂，热盛阳明入母膏。